中心静脉压高，血压低提示
A. 心功能不全，血容量正常
B. 血容量不足
C. 容量血管过度收缩
D. 心功能不全或血容量相对过多
E. 心功能不全或血容量不足

正确答案：D。心功能不全或血容量相对过多

解析：中心静脉压的大小取决于心脏射血能力和静脉回心血量之间的相互关系。中心静脉压（CVP）、血压（BP）的临床意义和处理方法如下：中心静脉压低、血压低，说明是血容量不足（B错），需充分补液；中心静脉压低、血压正常，血容量轻度不足，需适当补液；中心静脉压高、血压低，心功能不全/血容量相对过多（D对），需要强心和舒张血管；中心静脉压高、血压正常，容量血管收缩（C错），则需舒张血管。心功能不全时（AE错），中心静脉压是升高的。